病毒性肝炎肝胆湿热证，常用的中药是
A. 山萸肉、龟板
B. 柴胡、郁金
C. 龙胆草、栀子
D. 白术、扁豆
E. 黄芪、党参

正确答案：C。龙胆草、栀子

解析：病毒性肝炎肝胆湿热证常表现为右胁胀痛，脘腹满闷，恶心厌油，身目黄或无黄，小便黄赤，大便黏滞臭秽，舌苔黄腻，脉弦滑数，治疗当以龙胆草、栀子（C对）之类清利湿热之品以清热利湿解毒。山萸肉、龟板（A错）具有养血柔肝、滋阴补肾之功，常用于肝阴不足之证。柴胡、郁金（B错）具有疏肝理气解郁之功，常用于肝气郁结之证。白术、扁豆（D错）具有健脾益气渗湿之功，常用于脾虚湿盛之证。黄芪、党参（E错）具有补脾益气之功，常用于脾气虚弱之证。